关于维生素K临床应用的不良反应，下列说法错误的是
A. 维生素K毒性低
B. 静脉滴注维生素K1时，可产生血压下降，甚至发生虚脱
C. 维生素K3常导致胃肠道反应
D. 维生素K4较大剂量可导致新生儿溶血性贫血
E. 维生素K剂量过大会引起出血

正确答案：E。维生素K剂量过大会引起出血

解析：维生素K为促凝血药物，毒性低，静脉注射维生素K1速度快时，可产生血压下降，甚至发生虚脱。一般以肌肉注射为主。维生素K3和维生素K4常导致胃肠道反应，较大剂量可导致新生儿溶血性贫血。掌握“维生素K、抗贫血药和右旋糖酐”知识点。